情绪心理应激所致原发性高血压的机制中不包括
A. 交感－肾上腺髓质系统的兴奋
B. HPA激活
C. GC的作用
D. 血液粘滞度增高
E. 遗传易感性的激活

正确答案：D。血液粘滞度增高

解析：交感－肾上腺髓质系统的兴奋（A对）、HPA激活（B对）、.GC的作用（C对）和遗传易感性的激活（E对）均为情绪心理应激所致原发性高血压的机制，不包括血液粘滞度增高（D错，为本题正确答案）。